下列属于长效制剂的是（作用可维持24h以上）
A. 甲苯磺丁脲
B. 苯乙双胍
C. 普通胰岛素
D. 精蛋白锌胰岛素
E. 珠蛋白锌胰岛素

正确答案：D。精蛋白锌胰岛素

解析：本题考查胰岛素的分类。精蛋白锌胰岛素（D对）为长效的胰岛素制剂，皮下注射维持24～36h，可每日注射一次，满足糖尿病患者基础胰岛素的需要量。普通胰岛素（C错）为短效胰岛素制剂，皮下注射仅维持3～6h。 珠蛋白锌胰岛素（E错）为中效的胰岛素制剂，皮下注射维持12～18h。甲苯磺丁脲（A错）为磺酰脲类口服降糖药。苯乙双胍（B错）为双胍类口服降糖药。